女性，30岁。发热伴牙龈出血三周。查体：贫血貌，脾肋下3cm，胸骨压痛（+），血红蛋白70g/L，白细胞14.0×10⁹/L，血小板35×10⁹/L，骨髓增生明显活跃，原始细胞占0.62，为进一步诊断，应首选的检查是
A. 染色体核型分析
B. 细胞化学染色
C. 血清铁测定
D. 血细菌培养
E. 抗血小板抗体检测

正确答案：B。细胞化学染色

解析：患者青年女性，发热伴牙龈出血3周（感染、出血症状），查体：贫血貌，脾肋下3cm，胸骨压痛（+）（急性白血病常有肝脾、淋巴结肿大，胸骨下段局部压痛等白血病细胞增殖浸润的表现），血红蛋白70g/L（成年女性Hb正常值110～150g／L），提示贫血，白细胞14.0×10⁹/L（正常4～10×10⁹／L）增多，血小板35×10⁹/L（正常100～300×10⁹/L）（白血病患者血小板常减少），骨髓增生明显活跃，原始细胞占0.62（原始细胞≥骨髓有核细胞（ANC）的30%（FAB分型）或≥20%（WHO分型）即可诊断为急性白血病），故患者最可能的诊断为急性白血病。急性白血病诊断后，须进一步检查明确白血病类型，首选的检查为细胞化学染色（B对）。染色体核型分析（A错）应在明确白血病类型后进行，对于指导治疗，评价预后有重要作用；血清铁测定（P542）（C错）主要用于缺铁性贫血的诊断。血细菌培养（D错）主要用于感染性心内膜炎的诊断及确定感染性疾病的病原体种类；抗血小板抗体检测（P615）（E错）主要用于特发性血小板减少性紫癜的诊断。